药物微囊化的特点不包括
A. 可改善制剂的外观
B. 可提高药物稳定性
C. 可掩饰药物不良臭味
D. 可达到控制药物释放的目的
E. 可减少药物的配伍变化

正确答案：A。可改善制剂的外观

解析：本题考查微囊的特点。药物微囊化的特点不包括可改善制剂的外观（A错，为本题正确答案）。药物微囊化的特点：1. 提高药物的稳定性（B对）；2.掩盖药物的不良臭味（C对）；3.防止药物在胃内失活， 减少药物对胃的刺激性；4.控制药物的释放（D对）；5.使液态药物固态化；6.减少药物的配伍变化（E对）；7.使药物浓集于靶区。